因处方中所用的香加皮含强心苷而有毒，禁与含强心苷类西药同用的成药是
A. 跌打丸
B. 舒筋活血片
C. 活血止痛散
D. 接骨丸
E. 接骨七厘片

正确答案：B。舒筋活血片

解析：本题考查的是舒筋活血片的使用注意。因处方中所用的香加皮含强心苷而有毒，禁与含强心苷类西药同用的成药是舒筋活血片（B对）。舒筋活血片：【使用注意】孕妇忌服。妇女月经期慎服。因所用的香加皮含强心苷有毒，故不宜过量或持久服，禁与含强心苷类的西药同用。跌打丸（A错）：【注意事项】孕妇禁用。骨折、脱臼者宜手法先复位后再用本品治疗。饭后服用可减轻肠胃反应，脾胃虚弱者慎用。活血止痛散（C错）：【注意事项】孕妇禁用。宜在饭后半小时服用。脾胃虚弱者慎用。不宜大剂量使用。妇女月经期及哺乳期慎用。服药期间忌生冷、油腻食物。接骨丸（D错）：【注意事项】本品所含马钱子粉有大毒，故应在医生指导下使用。孕妇禁用。骨折、脱臼者应先复位后再用本品治疗。切勿过量服用或持久服用。接骨七厘片（E错）：【注意事项】孕妇禁用。骨折、脱臼者应先复位后再用本品治疗。脾胃虚弱者慎用。